佝偻病患儿每日需补充维生素D
A. 800～900IU
B. 900～1000IU
C. 1000～2000IU
D. 1000～2200IU
E. 1000～2500IU

正确答案：C。1000～2000IU

解析：维生素D缺乏性佝偻病是小儿体内维生素D不足致使钙磷代谢紊乱，产生的一种以骨骼病变为特征的全身慢性营养性疾病，其西医治疗以维生素D治疗为主，口服法：初期（轻度），维生素D每日1000～2000IU（C对）；激期（中、重度），每日3000～6000IU（ABDE错）。